抑制心肌及血管重构的抗心力衰竭药是
A. 呋塞米
B. 地高辛
C. 依那普利
D. 米力农
E. 多巴酚丁胺

正确答案：C。依那普利

解析：本题考查依那普利。依那普利（C对）是血管紧张素转换酶抑制剂，可同时作用于心肌及血管，抑制心肌及血管重构，缓解慢性心力衰竭症状，降低心衰患者死亡率。呋塞米（A错）是袢利尿剂。地高辛（B错）是强心苷类抗心衰药。米力农（D错）是磷酸二酯酶III抑制剂。多巴酚丁胺（E错）是β受体激动药，可用于心力衰竭。